某女，38岁。先天禀赋不足，近半年来月经延后7～10天，量少，色淡，伴四肢乏力，精神不振，面色无华；舌淡苔白，脉缓弱。诊断为月经后期，证属血虚血滞、经血运行不畅。宜选用的中成药是
A. 得生丸
B. 四物益母丸
C. 调经丸
D. 益母丸
E. 调经活血片

正确答案：B。四物益母丸

解析：本题考查的是月经后期的辨证论治。先天禀赋不足，近半年来月经延后7～10天，量少，色淡，伴四肢乏力，精神不振，面色无华；舌淡苔白，脉缓弱。诊断为月经后期，证属血虚血滞、经血运行不畅。宜选用的中成药是四物益母丸（B对）。月经后期：月经周期延后7天以上，甚至3～5个月一行者，称为“月经后期”。既往亦有称“经行后期”“月经延后”“月经错后”“经迟”等。一般认为要连续出现两个周期以上，若每次仅延后三五天，或偶然延后一次，下次仍如期来潮者，均不作月经后期论。此外，如在月经初潮后1年内，或月经将绝之时，周期时有延后，且无其他症状者，亦不作病论。西医学的月经稀发表现为上述症状者，可参考此内容辨证论治。（一）肾虚证：【中成药应用】常用中成药有春血安胶囊、天紫红女金胶囊。（二）血虚证：【中成药应用】常用中成药有复方益母草膏、四物益母丸。（三）气滞证：【中成药应用】常用中成药有益母丸（D错）、得生丸（A错）、调经丸（C错）、调经活血片（E错）。（四）痰湿证：【中成药应用】常用中成药有二陈丸。